硝苯地平的作用机制是
A. 影响机体免疫功能
B. 影响酶活性
C. 影响细胞膜离子通道
D. 阻断受体
E. 干扰叶酸代谢

正确答案：C。影响细胞膜离子通道

解析：本题考查药物的作用机制。硝苯地平的作用机制是影响细胞膜离子通道（C对）。有些药物可以直接作用于离子通道，产生药理作用。例如，局麻药利多卡因抑制Na⁺通道，阻断神经冲动的传导，产生局麻作用；钙通道阻滞药硝苯地平可以阻滞Ca²⁺通道，降低细胞内Ca²⁺浓度，引起血管舒张，产生降压作用。影响机体免疫功能（A错）免疫抑制药环孢素及免疫增强药左旋咪唑的作用机制。影响酶活性（B错）是抗高血压药物依那普利和解热、镇痛、抗炎药阿司匹林等的作用机制。阻断受体（D错）是阿托品、肾上腺素等药物的作用机制。干扰叶酸代谢（E错）是磺胺类抗菌药、喹诺酮类抗菌药的作用机制。